自律细胞与非自律细胞的区别是
A. 1期去极的快慢
B. 1期复极的快慢
C. 2期复极的快慢
D. 3期复极的快慢
E. 4期自动去极的有无

正确答案：E。4期自动去极的有无